男性，36岁，家庭装修工人，一次在油漆完地板后出现了兴奋，面部潮红，眩晕等醉酒样症状，有轻微的恶心、呕吐，其他无异常，经治疗后康复。该患者最有可能是
A. 慢性苯胺中毒
B. 急性苯中毒
C. 慢性苯中毒
D. 急性一氧化碳中毒
E. 以上都不是

正确答案：B。急性苯中毒